心肌炎时主要引起
A. 右心室容量负荷过重
B. 左心室压力负荷过重
C. 心肌结构损害
D. 心肌能量代谢障碍
E. 右心室压力负荷过重

正确答案：C。心肌结构损害

解析：心肌炎时，心肌细胞发生变性、坏死，引起心肌结构损害（C对），导致心肌收缩性降低。右心室容量负荷过重（A错）见于三尖瓣或肺动脉瓣关闭不全等。左心室压力负荷过重（B错）见于高血压、主动脉瓣狭窄等。心肌能量代谢障碍（D错）可见于冠心病、心肌肥大等。右心室压力负荷过重（E错）见于肺动脉高压或肺动脉瓣狭窄等。